检查某班15岁学生50名，其中患龋病者10人，龋失补牙数为：D=70，M=2，F=8。龋失补牙面数为：D=210，M=10，F=15，这班学生龋面均为
A. 0.8
B. 1.4
C. 1.6
D. 4.2
E. 4.7

正确答案：E。4.7

解析：本题考查龋面均的计算。检查某班15岁学生50名，其中患龋病者10人，龋失补牙数为：D=70，M=2，F=8。龋失补牙面数为：D=210，M=10，F=15，这班学生龋面均为4.7（E对）。龋面均指受检查人群中每人口腔中平均龋、失、补牙面数；龋均指受检查人群中每人口腔中平均龋、失、补牙数。龋面均=（210+10+15）/50=4.7。龋均=（70+2+8）/50=1.6（C错）。